急性肾炎的主要临床表现是
A. 水肿、蛋白尿、高血压、高脂血症
B. 高血压、血尿、蛋白尿、低蛋白血症
C. 水肿、血尿、少尿、高血压
D. 少尿、水肿、蛋白尿、高脂血症
E. 少尿、水肿、血尿、低蛋白血症

正确答案：C。水肿、血尿、少尿、高血压

解析：急性肾炎的主要临床表现是水肿、血尿、少尿、高血压（C对）等肾炎综合征的表现，形成机制如下：①肾小球滤过率降低，水、钠潴留引起水肿、高血压；②肾小球滤过率降低，水、钠潴留而尿量减少，少数患者甚至少尿；③由于肾小球基底膜损伤，红细胞通过该处时受血管内压力挤压受损，其后通过肾小管各段又受不同渗透压和pH作用，呈现变形红细胞血尿。肾病综合征（P461）的主要表现是大量蛋白尿、低白蛋白血症、明显水肿和（或）高脂血症。